下列药物合用时，具有增敏效果的是
A. 肾上腺素延长普鲁卡因的局麻作用时间
B. 罗格列酮与胰岛素合用提高降糖作用
C. 阿替洛尔与氢氯噻嗪联合用于降压
D. 克拉霉素和阿莫西林合用，增强抗幽门螺杆菌作用
E. 链霉素可延长氯化琥珀胆碱的肌松作用时间

正确答案：B。罗格列酮与胰岛素合用提高降糖作用

解析：本题考查增敏药。某药可使组织或受体对另一药的敏感性增强,称为增敏。例如，罗格列酮与胰岛素合用提高降糖作用（B对），罗格列酮为胰岛素增敏剂，可使胰岛素对受体靶组织的敏感性增加，减少肝糖的产生。肾上腺素延长普鲁卡因的局麻作用时间（A错）是药物的增强作用。阿替洛尔与氢氯噻嗪联合用于降压（C错）是相加作用。克拉霉素和阿莫西林合用增强抗幽门螺杆菌作用（D错）并不是增敏效果，两者都是抗生素。链霉素可延长氯化琥珀胆碱的肌松作用时间（E错）并不是增敏效果。